主治外科热毒痈疡的代表方是
A. 大黄牡丹汤
B. 千金苇茎汤
C. 普济消毒饮
D. 阳和汤
E. 仙方活命饮

正确答案：E。仙方活命饮

解析：仙方活命饮方含白芷、贝母、防风、赤芍、当归尾、甘草、皂角刺、穿山甲、天花粉、乳香、没药、金银花、陈皮，可清热解毒，消肿溃坚，活血止痛，主治外科热毒痈疡（E对）--以金银花为君，善清热解毒疗疮；以当归尾、赤芍、乳香、没药、陈皮为臣，行气活血通络，消肿止痛；白芷、防风疏风散表，以助散结消肿；贝母、花粉清热化痰散结；山甲、皂角刺透脓溃坚，均为佐药；甘草清热解毒兼调和诸药。